根据《关于加强中药饮片包装监督售管理的通知》，关于药品经营企业中药饮片管理要求的说法，错误的是
A. 中药饮片包装必须印有或贴有标签
B. 中药饮片分包装必须符合药品经营质量管理规范
C. 中药饮片在发运过程中必须有包装
D. 中药饮片发运包装须附有质量合格标志

正确答案：B。中药饮片分包装必须符合药品经营质量管理规范

解析：本题考查的是中药饮片生产管理。中药材市场经营者严禁从事饮片分包装、改换标签等活动（B错，为本题正确答案）。中药材市场经营者应完善购进记录、验收、储存、运输、调剂、临方炮制等过程的管理制度和措施。严禁从事饮片分包装、改换标签等活动。严禁从中药材市场或其他不具备饮片生产经营资质的单位或个人采购中药饮片，确保中药饮片安全。中药饮片包装必须印有或贴有标签（A对）。中药饮片的标签必须注明品名、规格、产地、生产企业、产品批号、生产日期、实施批准文号管理的中药饮片还必须注明批准文号。针对中药饮片存在无包装或包装不符合法定规定的情况，《关于加强中药饮片包装监督管理的通知》（国食药监办〔2003〕358号）指出：严禁选用与药品性质不相适应和对药品质量可能产生影响的包装材料。中药饮片在发运过程中必须要有包装（C对）。每件包装上必须注明品名、产地、日期、调出单位等，并附有质量合格的标志（D对）。对不符合上述要求的中药饮片，一律不准销售。